根据《中华人民共和国药品管理法实施条例》的规定，申请进口的药品未在生产国家或者地区取得上市许可的
A. 在限定条件下可以依法批准进口
B. 不允许进口
C. 经出口国或地区药品管理部门批准可以进口
D. 只要有市场就可以进口
E. 可无条件进口

正确答案：A。在限定条件下可以依法批准进口

解析：本题考查药品管理。申请进口的药品未在生产国家或者地区取得上市许可的在限定条件下可以依法批准进口（A对）。《中华人民共和国药品管理法实施条例》第三十五条规定，申请进口的药品，应当是在生产国家或者地区获得上市许可的药品；未在生产国家或者地区获得上市许可的，经国务院药品监督管理部门确认该药品品种安全、有效而且临床需要的，可以依照《药品管理法》及本条例的规定批准进口。进口药品，应当按照国务院药品监督管理部门的规定申请注册。国外企业生产的药品取得《进口药品注册证》，中国香港、澳门和台湾地区企业生产的药品取得《医药药品注册证》后，方可进口。